某女性患者，65岁。3年前因牙周病拔牙后行全口义齿修复，效果理想。半年前发现咀嚼效率下降。咀嚼效率下降最可能的原因是
A. 患者年龄增加，出现肌无力
B. 疼痛所致
C. 人工牙颌面磨损
D. 咬合不平衡
E. 患者的心理因素所致

正确答案：C。人工牙颌面磨损

解析：患者3年前全口修复效果理想，3年后咀嚼效率下降，最可能的原因是人工牙颌面磨损，导致咀嚼效率下降。A项属于一种疾病状态，不是最可能的原因。B项疼痛与咀嚼效率关系不大。D项咬合不平衡出现的是义齿不稳定，与咀嚼效率关系不大。E项患者心理因素不是最可能的原因。掌握“全口义齿戴入后问题及处理”知识点。